下列有关蛋白质的叙述哪项不正确
A. 蛋白质分子都具有一级结构
B. 蛋白质的二级结构是指多肽链的局部构象
C. 蛋白质的三级结构是整条肽链的空间结构
D. 蛋白质分子都具有四级结构
E. 蛋白质四级结构中亚基的种类和数量均不固定

正确答案：D。蛋白质分子都具有四级结构